主要含有强心苷的中药是
A. 麦冬
B. 知母
C. 香加皮
D. 黄芪
E. 肉桂

正确答案：C。香加皮

解析：本题考查的是香加皮的化学成分。主要含有强心苷的中药是香加皮（C对）。香加皮中含有强心苷类化合物为甲型强心苷，其中杠柳毒苷和杠柳次苷为主要成分。麦冬（A错）含有甾体皂苷，《中国药典》以鲁斯可皂苷元为对照品，测定麦冬总皂苷的含量，要求含量不得少于0.12%。知母（B错）的化学成分主要为甾体皂苷和芒果苷，还含有木脂素、甾醇、鞣质、胆碱等成分。《中国药典》上将知母皂苷BⅡ和芒果苷定为知母药材的质量控制成分，要求知母皂苷BⅡ含量不得少于3.0%，芒果苷的含量不得少于0.7%。饮片指标低于原药材，如蓝知母要求知母皂苷BⅡ含量不得少于2.0%，芒果苷含量不得少于0.40%。黄芪（D错）的化学成分众多，主要含皂苷类、黄酮类、多糖类及氨基酸类等。在黄芪及其同属近缘植物中共分离出40余种三萜皂苷。《中国药典》以黄芪甲苷和毛蕊异黄酮葡萄糖苷为指标成分进行药材和饮片的含量测定，要求药材含黄芪甲苷不得少于0.080%，含黄芪甲苷不得少于0.060%；要求药材和饮片含毛蕊异黄酮葡萄糖苷不得少于0.020%。肉桂（E错）皮含挥发油1%～2%。《中国药典》以桂皮醛为指标成分进行含量测定，并以挥发油作为质量控制指标，要求其含量不得少于1.2%（ml/g）。油中的主要成分为肉桂醛含量达75%～85%，并含少量乙酸桂皮酯、肉桂酸、乙酸苯丙酯等。